氰化物中毒时，病人的呼吸气味可呈
A. 烂苹果味
B. 蒜臭味
C. 腥臭味
D. 酒味
E. 苦杏仁味

正确答案：E。苦杏仁味

解析：氰化物中毒时，呼吸气味有苦杏仁味（E对）。烂苹果味见于糖尿病酮症酸中毒（A错）。蒜臭味见于有机磷农药、黄磷、铊等中毒（B错）。腥臭味见于肝性脑病（C错）。酒味见于急性乙醇中毒（D错）。